疾病分布是指
A. 民族分布、性别分布、职业分布
B. 时间分布、地区分布、人群分布
C. 城乡分布、年龄分布、民族分布
D. 民族分布、年龄分布、职业分布

正确答案：B。时间分布、地区分布、人群分布

解析：本题考查疾病分布。疾病分布是指时间分布、地区分布、人群分布（B对ACD错）。